葡萄球菌感染灶内浸润的主要炎症细胞是
A. 单核细胞
B. 中性粒细胞
C. 嗜酸性粒细胞
D. 淋巴细胞
E. 嗜碱性粒细胞

正确答案：B。中性粒细胞

解析：葡萄球菌感染属于常见的细菌性感染，感染灶内浸润的主要炎症细胞是中性粒细胞（B对）。单核细胞（A错）和淋巴细胞（D错）浸润常见于慢性炎症，淋巴细胞浸润还多见于病毒性感染。嗜酸性粒细胞（C错）浸润主要见于寄生虫感染。嗜碱性粒细胞（E错）可见于某些超敏反应，无较强的特异性。